（119～121共用题干）男，45岁。8个月前骑电动车时摔倒，上腹部被车把撞伤并疼痛，经治疗后缓解。6个月前觉上腹部逐渐隆起，伴上腹饱胀，近日来常恶心、呕吐。查体：上腹部可触及直径约10cm包块，无肌紧张、压痛、反跳痛。影像学检查提示该患者上腹部10cm×10cm囊性肿物，最有可能的诊断是
A. 腹部后血肿
B. 膈疝
C. 肝左叶囊肿
D. 胰腺假性囊肿
E. 十二指肠憩室

正确答案：D。胰腺假性囊肿

解析：该患者8个月前有撞伤史（上腹部创伤均应考虑胰腺损伤的可能），6个月前觉上腹部逐渐隆起（胰腺假性囊肿易漏诊），伴上腹饱胀，近日来常恶心、呕吐。上腹部可触及直径约10cm 包块，影像学检查提示该患者上腹部10cm×10cm囊性肿物，综合患者的病史、临床变现和影像学检查，应诊断为胰腺假性囊肿（D对）。腹膜后血肿（P327）（A错）腹痛为最常见症状，血肿巨大或伴有渗入腹膜腔者可有腹肌紧张和反跳痛、肠鸣音减弱或消失。膈疝（B错）的主要临床表现是进食后上腹部不适或者疼痛、嗳气、恶心、呕吐等。肝左叶囊肿（P421）（C错）可触及右上腹肿块和肝大。绝大部分的十二指肠憩室（P352）（（E错）是由于先天性十二指肠局部肠壁基层缺陷所致，绝大多数无症状，少数表现为上腹部疼痛、恶心、嗳气、在饱食后加重。